粉尘是指能够较长时间浮游在空气中的
A. 液滴
B. 固体微粒
C. 烟
D. 雾
E. 细菌

正确答案：B。固体微粒

解析：本题考查粉尘的性质。生产性粉尘是在生产活动中产生的能够较长时间漂浮于生产环境中的固体颗粒物。无论是何种粉尘，无论粉尘的颗粒有多小，它的性质都是固体粒子（B对ACDE错）。